发育期的根端复合体最终能够形成
A. 牙髓-牙本质复合体
B. 牙根-牙周组织复合体
C. 牙骨质-牙周膜复合体
D. 牙槽骨-牙周膜复合体
E. 年轻恒牙根尖乳头

正确答案：B。牙根-牙周组织复合体

解析：本题考查牙体、牙周组织的形成。牙根发育过程中，上皮根鞘、牙乳头和牙囊，这三者在牙发育早期作为一个整体性的功能复合物被称为发育期根端复合体。具有较强的增殖能力和矿化能力。被分离的发育期根端复合体在体外，体内仍具有形成牙根-牙周组织复合体（B对）的能力。